由病人的家长、家属或他人作出求医决定的求医类型是
A. 主动
B. 被动
C. 强制
D. 稳定
E. 独立

正确答案：B。被动

解析：求医行为是指在人们感到某种躯体不适或产生病感时寻求医疗帮助的行为，可分为主动求医行为、被动求医行为和强制性求医行为。主动求医（A错）行为是指人们为治疗疾病、维护健康而主动寻求医疗帮助的行为，是人们通常的求医行为。被动求医（B对）行为指得是病人无法和无能力作出求医决定和实施求医行为，而由第三者帮助代为求医的行为，如婴幼儿病人、处于休克、昏迷中的病人、垂危病人等，必须由家长、亲友或者其他护理人员的帮助才能去求医。强制求医行为（C错）指得是公共卫生机构或病人的监护人为了维护人群或病人的健康和安全而给予强制性治疗的行为，主要是针对有严重危害的传染性 疾病和精神病病人。